25岁男性，春季，主诉寒战、高热，剧烈头痛1天，呕吐3次，查体：神志清楚，体温39.8℃，颈强直（+），皮肤有瘀点，咽部略充血，心肺腹无异常，克氏征（-），血白细胞20×10⁹/L，中性粒细胞85%，腰穿：脑脊液米汤样，细胞数3000×10⁶/L，中性粒细胞80%，糖1.12mmol/L。最可能的诊断是
A. 流行性乙型脑炎
B. 结核性脑膜炎
C. 化脓性脑膜炎
D. 流行性脑脊髓膜炎
E. 脑型疟疾

正确答案：D。流行性脑脊髓膜炎

解析：患者春季发病，寒战，高热，皮肤有瘀点，咽部充血（败血症期表现）；剧烈头痛、呕吐，颈强直（+）（脑膜炎期表现）；检查血中白细胞中性粒细胞升高，脑脊液米汤样，细胞数和中性粒细胞皆升高，糖减少，最可能的诊断是流行性脑脊髓膜炎（D对）。流行性乙型脑炎（A错）为病毒感染，常表现为外周血白细胞轻度升高，且以淋巴细胞增多为主。结核性脑膜炎（B错）起病缓慢，多于1～2周非特异性感染症状后，出现脑膜刺激征。化脓性脑膜炎（C错）起病急，感染症状明显，克氏征阳性。脑型疟疾（E错）是恶性疟的严重临床类型，主要表现为剧烈头痛、发热，常出现不同意识障碍，无皮疹。